一12岁女孩儿，一年前月经一次来潮，之后有时2～3个月来一次月经，有时1个月来一次，且经量较少，现已有半年未来月经，可能的诊断是
A. 功能性子宫出血
B. 原发性闭经
C. 继发性闭经
D. 正常月经
E. 黄体功能不足

正确答案：D。正常月经

解析：本题考查月经的相关内容。功能性子宫出血（A错）主要表现有月经周期紊乱、经期长短不一，阴道不规则出血，出血量时多时少，时出时停，出血量多少不定。原发性闭经（B错）是女性年龄超过15岁，第二性征已发育，或年龄超过13岁，第二性征仍未发育，且无月经来潮者。继发性闭经（C错）是曾经建立正常月经，但以后因某些病理性原因月经停止6个月以上者，或按自身原来月经周期计算停经3个周期以上者。黄体功能不足（E错）的病人平时无不适症状，若出现临床表现，主要为月经周期缩短、月经频发、不孕或流产，而流产主要发生在孕早期。该女孩11岁初潮，因此排除原发性闭经，而目前月经周期仍不规则，虽然已有半年未来月经，但因其还未建立正常月经周期，因此排除继发性闭经。经量较少，排除功能性子宫出血的可能，所以为正常月经（D对）。